正常安静，清醒闭目时出现
A. α波
B. β波
C. θ波
D. δ波
E. 以上均不是

正确答案：A。α波